下列关于胺碘酮的叙述，错误的是
A. 为广谱抗心律失常药
B. 降低窦房结和浦肯野纤维的自律性
C. 减慢浦肯野纤维和房室结的传导速度
D. 显著延长心房肌、心室肌及浦肯野纤维的动作电位时程和有效不应期
E. 以上都不是

正确答案：E。以上都不是